患儿，2岁。患疱疹性口炎，舌上舌边溃烂，色赤疼痛，烦躁多啼，小便短黄，舌尖红，苔薄黄，指纹紫，治疗应首选的方剂是
A. 凉膈散
B. 泻心导赤散
C. 清热泻脾散
D. 清胃散
E. 泻黄散

正确答案：B。泻心导赤散

解析：疱疹性口炎心火上炎证症状：心火上炎舌窍故见舌上、舌边溃烂，色赤疼痛；心火炽盛，热扰心神故见烦躁多啼；热盛伤津故见口干欲饮，小便短黄；火热内盛故见舌尖红，苔薄黄，脉数，指纹紫滞。治法：清心凉血，泻火解毒。方药：泻心导赤散加减（B对）。凉膈散具有清热解毒，泻火解毒，清上泄下之功效。主治上中焦邪郁生热证（A错）。清热泻脾散清脾泄热。治疗小儿心脾蕴热，致患鹅口，白屑生满口舌，如鹅之口者（C错）。清胃散具有清脏腑热，清胃凉血之功效。主治胃火牙痛（D错）。泻黄散泻脾胃伏火，治疗脾胃伏火证，目疮口臭，烦渴易饥，口燥唇干，舌红脉数，以及脾热弄舌等（E错）。